不属于右心房的是
A. 下腔静脉口
B. 冠状窦口
C. 上腔静脉口
D. 右房室瓣
E. 动脉圆锥

正确答案：E。动脉圆锥

解析：下腔静脉口（A对）、冠状窦口（B对）、上腔静脉口（C对）、右房室瓣（D对）均位于右心房。动脉圆锥（E错，为本题正确答案）位于右心室内。